具备下列条件的可以参加执业助理医师资格考试：具有高等学校医学专科学历，在医疗、预防、保健机构中试用期满
A. 6个月
B. 18个月
C. 1年
D. 2年
E. 3年

正确答案：C。1年